根尖诱导成形术成功标准，除外的是
A. 根尖继续发育，管腔缩窄，根尖封闭
B. 根管腔无变化，根尖封闭
C. 根管内有微量有颜色液体排出
D. 未见发育，根管内探测有硬组织屏障形成
E. 根端1/3处形成钙化屏障

正确答案：C。根管内有微量有颜色液体排出

解析：本题考查年轻恒牙牙髓病及根尖周病诊断及治疗。根管内有微量有颜色液体排出（C错，为本题正确答案）不是根尖诱导成形术成功标准。根尖诱导成形术成功标准：根尖周病变消失，牙根延长，根尖形成或根端闭合。根据Frank研究，根尖诱导成形术牙根发育类型分为4类：①根尖继续发育，管腔缩窄，根尖封闭（A对）。②根管腔无变化，根尖封闭（B对）。③未见发育，根管内探测有硬组织屏障形成（D对）。④根端1/3处形成钙化屏障（E对）。